男，19岁。初发肾病综合征，应用泼尼松60mg/d治疗8周，水肿无明显好转，复査尿蛋白仍大于3.5g/d，肾活检提示微小病变型肾病。下一步最适宜的治疗是
A. 加用人血白蛋白
B. 加用免疫抑制剂
C. 增加泼尼松剂量
D. 大剂量静脉应用免疫球蛋白
E. 加用ACEI/ARB

正确答案：B。加用免疫抑制剂

解析：青年男性患者，初发肾病综合征，活检提示微小病变型肾病（即脂性肾病，多见于儿童，肾脏病变较轻，预后良好，较少发展为急性肾衰竭），应用泼尼松60mg/d治疗8周，水肿无明显好转，复查尿蛋白仍大于3.5g/d（正常值小于150mg/d，提示激素治疗效果不佳），可诊断该患者为“激素抵抗型”。因此，该患者下一步治疗最应该加用细胞毒药物或免疫抑制剂（B对）。人血白蛋白（A错），大剂量静脉应用免疫球蛋白（D错）对肾病综合征患者无明显疗效，不用于肾病综合征患者。增加泼尼松剂量（C错），对“激素抵抗型”肾病综合征效果不佳且大剂量激素对患者副作用较大。ACEI/ARB（E错）常用于糖尿病肾病合并高血压患者的治疗。